男性，37岁。左上后牙进食冷热饮食和咬硬物时酸痛1周。无自发痛。口腔检查：左上67磨损达牙本质，探诊酸痛。温度刺激试验酸痛，刺激去除后症状即刻消失。不松动，牙周检查（-）。首选的治疗措施是
A. 牙髓治疗
B. 药物脱敏
C. 牙周洁治
D. 银汞充填
E. 复合树脂充填

正确答案：B。药物脱敏

解析：本题考查牙本质敏感症的治疗。男性，37岁。左上后牙进食冷热饮食和咬硬物时酸痛1周。无自发痛。口腔检查：左上67磨损达牙本质，探诊酸痛。温度刺激试验酸痛，刺激去除后症状即刻消失。不松动，牙周检查（-）。首选的治疗措施是药物脱敏（B对）。患者左上67磨损达牙本质，探诊酸痛，可知患牙是由严重磨损引起的牙本质敏感。对于有牙本质暴露者，应首选药物脱敏治疗；若药物脱敏无效，患者感到非常痛苦，强烈要求治疗，且患牙数目较少者，可考虑人工冠修复，甚至牙髓治疗（A错）。患者牙齿不松动，牙周检查（-），无牙周症状，可不用进行牙周洁治（C错）。银汞合金是良导体可传导冷热刺激，复合树脂对牙髓有刺激作用，不能用于牙本质敏感的直接充填修复（DE错）。